患者，女性，50岁，因上颌窦癌行上颌骨全切除术，口腔内创面需行游离植皮术，在右大腿取皮。关于受植区皮片的最确切的处理是
A. 不固定
B. 缝合固定
C. 缝合后碘仿纱条反包扎固定
D. 医用胶水固定
E. 缝合后无菌棉花反包扎固定

正确答案：C。缝合后碘仿纱条反包扎固定

解析：本题考查受植区皮片的处理。缝合后用碘仿纱条反包扎固定（C对），可提高受植区皮片的存活率并防止皮片感染，使皮片与周围组织衔接良好，能得到充分的血供。若不固定皮片（A错），皮片未能与组织严密接触，皮片将不能正常生长，会发生坏死。不用碘仿纱条直接缝合固定（B错），易形成血肿，且不利于创口感染的控制。只用医用胶水固定（D错），皮片存活率不高，易发生感染而坏死。缝合后用无菌棉花反包扎固定（E错）的效果没有碘仿纱条固定的效果好，且碘仿纱条还可起到一定的消炎杀菌的作用，应优先选用碘仿纱条反包扎固定。